蒸馏法可以提取
A. 强心苷
B. 生物碱
C. 挥发油
D. 羟基黄酮
E. 蛋白酶

正确答案：C。挥发油

解析：本题考查的是水蒸气蒸馏法。蒸馏法可以提取挥发油（C对）。挥发油也称精油，是存在于植物体内的一类可随水蒸气蒸馏、与水不相混溶的挥发性油状液体。水蒸气蒸馏法：适用于具有挥发性的、能随水蒸气蒸馏而不被破坏，且难溶或不溶于水的化学成分的提取。此类化合物的沸点多在100℃以上，并在100℃左右有一定的蒸气压。